患者，女，75岁，近来因家庭变故出现焦虑相关的精神和躯体症状，入睡困难，多梦易惊醒，诊断为焦虑症。核查其用药记录，患者在服用氨氯地平、阿托伐他汀钙。老年人使用上题建议选用的抗焦虑药物需要关注的风险是
A. 极度烦躁不安的自伤和伤人行为
B. 心悸、震颤
C. 可致宿醉现象，容易跌倒
D. 体重增加
E. 5-羟色胺综合征

正确答案：C。可致宿醉现象，容易跌倒

解析：本题考查抗焦虑药物的不良反应。老年人使用苯二氮䓬类药物可致宿醉现象，容易跌倒（C对）。用苯二氮䓬类药物后，可致人体的平衡功能失调，尤其是老年人对作用于中枢系统疾病的药物反应较为敏感，服用本类药后，可产生过度镇静、肌肉松弛作用，觉醒后可发生震颤、思维迟缓、运动障碍、认知功能障碍、步履蹒跚、肌无力等“宿醉”现象，极易跌倒和受伤。